关于子宫破裂描述正确的是
A. 先兆子宫破裂应引导分娩
B. 子宫破裂伴胎儿死亡应经阴道引产
C. 有病理缩复环应考虑先兆子宫破裂
D. 有古典式剖宫产史的子宫不易破裂
E. 有血尿即可诊子宫破裂

正确答案：C。有病理缩复环应考虑先兆子宫破裂

解析：先兆子宫破裂因胎先露部下降受阻，子宫收缩过强，子宫体部肌肉增厚变短，子宫下段肌肉变薄拉长，在两者间形成环状凹陷，称为病理缩复环（C对）。先兆子宫破裂应立即抑制子宫收缩，尽快行剖宫产手术（A错），术中注意检查子宫是否已有破裂。子宫破裂胎儿未娩出者，即使死胎也不应经阴道先娩出胎儿（B错），这会使裂口扩大，增加出血，促使感染扩散，应迅速剖腹取出死胎。古典式剖宫产切口部肌肉组织厚，缝合常不理想，出血多，再孕时子宫破裂率高（D错）。血尿也可见于泌尿系统疾病（E错）。